NK细胞的表面分子
A. CD3
B. CD19
C. KIR
D. MHC-Ⅱ
E. IL-2

正确答案：C。KIR

解析：T细胞表面分子有CD3（A错）、CD4和CD8。B细胞表面分子有CD19（B错）、CD20、CD21、CD40等。KIR（杀伤细胞免疫蛋白样受体）（C对）、CD16、CD56是NK细胞的表面分子。MHC-Ⅱ（D错）是树突状细胞的表面分子。IL-2（E错）是细胞因子中的一种，由活化的T细胞产生，主要作用是刺激T细胞的生长和分化，激活NK细胞和巨噬细胞，促进CTL的功能。